以下溶液在重金属检查硫代乙酰胺法中用到的是
A. 0.1mol/L盐酸
B. 0.1mol/L高氯酸
C. 醋酸缓冲溶液（pH3.5）
D. 0.9%氯化钠
E. 0.1mol/L氢氧化钠溶液

正确答案：C。醋酸缓冲溶液（pH3.5）

解析：本题考查重金属检查法。以下溶液在重金属检查硫代乙酰胺法中用到的是醋酸缓冲溶液（pH3.5）（C对）。硫代乙酰胺法：硫代乙酰胺在弱酸性（pH为3.5的乙酸盐缓冲液）条件下水解，产生硫化氢与微量重金属离子，生成黄色到棕黑色的硫化物均匀混悬液，与一定量的标准铅溶液经同法处理后所呈的颜色比较，判定供试品中的重金属是否符合限量规定。